两次月经第一天相隔的时间
A. 月经期
B. 增殖期
C. 分泌期
D. 分泌晚期
E. 月经周期

正确答案：E。月经周期

解析：出血第一日为月经周期开始，相邻两次月经第一日的间隔时间，称为一个月经周期。掌握“女性生殖系统生理”知识点。